面神经不支配
A. 颞肌
B. 颊肌
C. 眼轮匝肌
D. 口轮匝肌
E. 下颌下腺

正确答案：A。颞肌

解析：面神经的颅外分支中，颞支支配额肌、眼轮匝肌（C错）；颧支支配眼轮匝肌（C错）和颧肌；颊支支配颊肌（B错）、口轮匝肌（D错）及其他口周围肌。面神经进入下颌下神经节换元后，节后纤维分布于舌下腺、下颌下腺（E错）。颞肌（A对）由咀嚼肌神经（下颌神经的分支）支配。